哪项不是病毒感染对宿主细胞的直接作用
A. 杀细胞性感染
B. 稳定状态感染
C. 基因组整合
D. 形成包涵体
E. 产生超敏反应

正确答案：E。产生超敏反应

解析：病毒对宿主细胞的直接作用：不同病毒与宿主细胞之间的相互作用，有多种多样的作用类型，可分为杀细胞性感染，稳定状态感染、基因组整合、包涵体形成、细胞增生与转化、促进细胞凋亡等类型。超敏反应不是病毒的直接作用。掌握“病毒传播方式、感染类型、致病机制及免疫”知识点。